漏诊率是指
A. 实际有病，试验阳性
B. 实际有病，试验阴性
C. 实际无病，试验阳性
D. 实际无病，试验阴性
E. 试验阳性，实际有病的可能

正确答案：B。实际有病，试验阴性